面部损伤后，组织水肿迅速发生，易影响呼吸道顺畅，甚至引起窒息的部位中不包括
A. 口底
B. 舌根
C. 下颌下区
D. 颈部
E. 颧上颌区

正确答案：E。颧上颌区

解析：本题考查可引起窒息的部位。颧上颌部的损伤，会造成面中部、颧部、上颌部的软组织肿胀，肿胀部位远离呼吸道（E错，为本题的正确答案）。口底（A对）、舌根（B对）、颈部（D对）损伤造成软组织的肿胀，堵塞口咽，压迫呼吸道，引起窒息。下颌下区损伤可造成口底和舌根的肿胀（C对）而影响呼吸道通畅，甚至引起窒息。